《中药品种保护条例》适用于
A. 中国境内生产制造的中成药
B. 中国境内生产制造的天然药物的提取物及其制剂
C. 中国境内加工的中药饮片
D. 中国境外生产制造的中药品种
E. 中国境内的中药人工制品

正确答案：A、B、E。中国境内生产制造的中成药；中国境内生产制造的天然药物的提取物及其制剂；中国境内的中药人工制品

解析：本题考查《中药品种保护条例》的适用范围。《中药品种保护条例》适用于中国境内生产制造的中成药（A对）、中国境内生产制造的天然药物的提取物及其制剂（B对）和中国境内的中药人工制品（E对）。